正常情况，牙冠的大部分显露于口腔，其中龈缘上方的牙体部分被称为
A. 临床牙冠
B. 解剖牙冠
C. 牙根
D. 牙颈
E. 釉质牙骨质界

正确答案：A。临床牙冠

解析：正常情况下，牙冠的大部分显露于口腔，其中龈缘上方的牙体部分被称为临床牙冠。掌握“牙的组成、分类、功能及牙位记录”知识点。